动脉粥样硬化的易患因素中以哪种因素占重要地位
A. 脂质代谢异常
B. 家族史
C. 糖尿病
D. 饮食习惯
E. 缺乏体力活动

正确答案：A。脂质代谢异常